从低级中枢到达支配的器官(效应器)中间需要换一次神经元的是
A. 植物性神经
B. 脊神经
C. 脑神经
D. 混合神经
E. 没有这种情况

正确答案：A。植物性神经

解析：内脏运动神经自低级中枢发出后必须在周围部的内脏运动神经节（植物性神经节）（A对）交换神经元，由节内神经元再发出纤维到达效应器。